血中PaCO₂升高引起呼吸加深加快是因为
A. 直接刺激中枢的呼吸神经元
B. 刺激中枢化学感受器
C. 刺激颈动脉体和主动脉体感受器
D. 刺激颈动脉窦和主动脉弓感受器
E. 刺激心肺感受器

正确答案：B。刺激中枢化学感受器

解析：CO₂刺激呼吸运动有两条途径，即刺激中枢化学感受器或外周化学感受器。中枢化学感受器在CO₂引起的通气反应中起主要作用，其作用机制是血液中的CO₂能迅速透过血-脑屏障，使化学感受器周围细胞液中的H⁺浓度升高，从而刺激中枢化学感受器（B对），进而影响呼吸中枢的活动（A错），使呼吸运动加深加快，肺通气量增加。而颈动脉体和主动脉体感受器（C错）属于外周化学感受器。颈动脉窦和主动脉弓（D错）属于压力感受器，其调节的是血压。心肺感受器（E错）调节的是循环血量和细胞外液量。